下列国家中安乐死合法化的是
A. 日本
B. 比利时
C. 澳大利亚
D. 美国
E. 新加坡

正确答案：B。比利时

解析：目前已立法容许安乐死的地方有荷兰、比利时（B对）、卢森堡、瑞士和美国（D错）的俄勒冈州、华盛顿州和蒙大拿州等地。奥地利、丹麦、法国、德国、匈牙利、挪威、斯洛伐克、西班牙、瑞典和瑞士10国，允许“被动”安乐死，只准终止为延续个人生命而治疗的做法。